男35岁。腹泻腹痛伴低热乏力、盗汗2个月。查体：右下腹可触及包块，压痛（+），边界不清。结肠镜发现回盲部环形溃疡。最有诊断价值的检查是
A. X线钡餐检查
B. CT检查
C. 粪便查菌
D. 结核菌素试验
E. 结肠镜下活检

正确答案：E。结肠镜下活检

解析：患者腹泻腹痛（腹痛+大便习惯改变），伴低热乏力、盗汗2个月（结核感染特征性临床表现），右下腹可触及包块，压痛（+），边界不清。结肠镜发现回盲部环形溃疡，综上考虑诊断为肠结核，最有诊断价值的检查是结肠镜下活检（E对），活检发现肉芽肿、干酪坏死或抗酸杆菌时，可以确诊。